人群易感性是
A. 遗传决定的
B. 后天获得的
C. 由遗传和后天的因素共同决定的
D. 是不会改变的
E. 是感染以后产生的

正确答案：C。由遗传和后天的因素共同决定的

解析：本题考查人群易感性的相关内容。人群易感性是由遗传和后天的因素共同决定的（C对ABDE错）。